对诊断急性胰腺炎最有价值的血清酶检查是
A. 谷草转氨酶
B. 淀粉酶
C. 碱性磷酸酶
D. 谷丙转氨酶
E. 乳酸脱氢酶

正确答案：B。淀粉酶

解析：对诊断急性胰腺炎最有价值的血清酶检查是淀粉酶（AMY）（B对）。谷草转氨酶临床上常作为肝脏疾病、心肌梗死和心肌炎的辅助检查（A错）。碱性磷酸酶在碱性环境中能水解磷酸酯产生磷酸，主要分布在肝脏、骨骼、肾、小肠及胎盘中，常作为肝脏疾病的检查指标之一（C错）。谷丙转氨酶是诊断病毒性肝炎、中毒性肝炎的重要指标（D错）。乳酸脱氢酶可作为鉴别细菌性和病毒性脑膜炎的重要指标（E错）。